消化性溃疡的患者，使用奥美拉唑治疗的机制是
A. 竞争性抑制剂
B. 非竞争性抑制剂
C. 不可逆性抑制剂
D. 可逆性抑制剂
E. 受体激动剂

正确答案：C。不可逆性抑制剂

解析：奥美拉唑是H⁺-K⁺-ATP酶抑制药，他们都属于弱酸性的苯并咪唑类化合物，pH约为4。此类药物为前体药物，其激活需要酸性环境。在酸性的壁细胞分泌小管内，转化为次磺酸和亚磺酰胺。后者与H⁺-K⁺-ATP酶a亚单位的巯基共价结合使酶失活，减少胃酸分泌，共价结合不可逆，所以属于不可逆性抑制剂（C对）。